治疗月经后期虚寒证，应首选
A. 温经汤（《妇人大全良方》）
B. 温经汤（《金匮要略》）
C. 血府逐瘀汤
D. 艾附暖宫丸
E. 少腹逐瘀汤

正确答案：B。温经汤（《金匮要略》）

解析：月经后期血寒证分为虚寒证与实寒证，其中虚寒证是以脾肾阳虚为主，治疗扶阳祛寒调经选择温经汤（《金匮要略》）（B对）。实寒证以寒凝冲任为主，治疗温经散寒调经选择（《妇人大全良方》）（A错）。血府逐瘀汤主治证候多为瘀血阻滞，气机郁滞所致，表现为腹痛，痛如针刺而有定处（C错）。艾附暖宫丸功用理气养血，暖宫调经。主治：血虚气滞，下焦虚寒所致的月经不调、痛经，症见行月经后期有血块，小腹疼痛，腹痛喜暖（D错）。少腹逐淤汤功用活血祛瘀，温经止痛。主治：痛经寒凝血淤证。主要症状：少腹瘀血积块疼痛或不痛，或痛而无积块，或少腹胀满，或经期腰酸，少腹作胀（E错）。